既涩肠止泻，又敛肺利咽的药是
A. 莲子肉
B. 诃子
C. 桔梗
D. 射干
E. 罂粟壳

正确答案：B。诃子

解析：本题考查的是诃子的功效。既涩肠止泻，又敛肺利咽的药是诃子（B对）。诃子：【功效】涩肠，敛肺，下气，利咽。莲子肉（A错）：【功效】补脾止泻，益肾固精，止带，养心安神。桔梗（C错）：【功效】宣肺，利咽，祛痰，排脓。射干（D错）：【功效】清热解毒，祛痰利咽，散结消肿。罂粟壳（E错）：【功效】敛肺，涩肠，止痛。